顺利完成各种活动所必备的基本能力是
A. 语言能力
B. 想象能力
C. 辨别能力
D. 特殊能力
E. 一般能力

正确答案：E。一般能力